患者张某，疑似伤寒入院，两次取血做肥达反应的结果如下：入院后第四天结果，TH1：80，TO1：80，TTBTC1：40；入院后第十二天，THTO1：320，TTBTC1：40，可诊断为
A. 伤寒
B. 甲型副伤寒
C. 乙型副伤寒
D. 沙门菌早期感染
E. 回忆反应

正确答案：A。伤寒

解析：根据患者两次取血做肥达反应的结果：入院后第四天结果，TH 1：80，TO 1：80，TA、TB、TC 1：40；入院后第十二天，TH、TO 1：320，TA、TB、TC l：40，可知入院第四天和第十二天，O抗体效价有4倍以上的升高，H抗体效价为1：320（大于1：160），对伤寒有辅助诊断意义，结合患者的临床表现，可诊断伤寒（A对）；抗甲、乙、丙型副伤寒的抗体效价未变，因此排除甲、乙、丙型副伤寒（BC错）。肥达试验结果诊断价值总结如下：1、二者均超过正常值，则伤寒的可能性大（A对）；2、二者均在正常范围内，患伤寒可能性小；3、H抗体效价超过正常值，O抗体效价正常，可能是接种了伤寒疫苗或者是接种的回忆反应（E错）；4、O抗体效价超过正常值，H抗体效价正常，可能是伤寒早期或其他沙门氏菌感染（D错）；5、试验必须动态观察，一般5～7天复查一次，效价逐渐升高，辅助诊断意义也随着升高。